心理治疗与病人之间的主要特点为
A. 单向性
B. 时限性
C. 正式性
D. 系统性
E. 以上说法均正确

正确答案：E。以上说法均正确

解析：心理治疗与病人之间的关系并不等于一般的友谊关系。其主要特点为：单向性、系统性、正式性、时限性。掌握“心理治疗原则、主要方法及应用”知识点。